医生赵某，在门诊值班时发现一患有霍乱病人，但未予以隔离治疗，经诊治后让患者回家，结果使患者家人都患上该病，有关卫生行政部门对其进行行政处分。医生对处分不满，他应该在多长期限内向上一级卫生行政部门申请复议
A. 一个月内
B. 十五日内
C. 十日内
D. 六十日内
E. 随时都可以

正确答案：B。十五日内

解析：医生对处分不满，他应该在十五日内向上一级卫生行政部门申请复议（B对）。